可表现犬吠样咳嗽伴呼吸困难的疾病是
A. 胸膜炎
B. 肺炎链球菌肺炎
C. 空洞型肺结核
D. 支气管扩张
E. 喉头水肿

正确答案：E。喉头水肿

解析：犬吠样咳嗽伴呼吸困难的疾病是喉头水肿（E对）。胸膜炎（A错）、肺炎链球菌肺炎（B错）、支气管肺癌、肺阻塞和自发性气胸等表现为咳嗽伴胸痛（人卫八版诊断学P17）。空洞型肺结核（C错）、支气管扩张（D错）、慢性支气管炎、肺炎、肺脓肿等表现为咳嗽伴咳痰。